某小学组织学生接种乙肝疫苗，有学生因出现头痛、呕吐、四肢乏力因而送到医院就诊，首诊医师及时处置并报告医院有关部门，经医护人员解释、安抚后，39名学生未经治疗症状很快消失，5名学生仍感恶心，并伴有焦虑。医院组织专家会诊后排除了疫苗和其他躯体疾病所致。首诊医师及时处置并报告医院有关部门所遵循的伦理要求是
A. 信息公开
B. 耐心倾听
C. 保守医密
D. 恪尽职责
E. 知情同意

正确答案：D。恪尽职责

解析：本题中，学生预防接种后出现群体心因性反应，属Ⅲ级突发公共卫生事件，按《突发公共卫生事件应急条例》规定，必须及时上报，故首诊医师及时处置并报告医院有关部门所遵循的伦理要求是恪尽职责（D对）。信息公开（A错）是指在公共卫生行动过程中保持公共卫生信息和公共卫生行动政策与决策的公开与透明，是实现程序公正的基本要求。耐心倾听（B错）是指认真仔细地倾听病人对病情的陈述。保守医密（C错）是指保守病人的秘密（病人不愿意公开透露的信息）以及对病人保守秘密（不良的诊断、进展、预后等）。知情同意（E错）是指在医学服务过程中，医方告知病人病情、诊治决策等医学信息并求得对方承诺与病人知晓这些信息后做出自主选择（同意或不同意接受诊治）的互动过程。